假设检验时所犯的两类错误的关系是
A. n一定时，α减小则β减小
B. n一定时，α减小则β增大
C. α值改变与β无关
D. n一定时，α越大β越大
E. α等于1－β

正确答案：B。n一定时，α减小则β增大